小便淋漓不尽，夜尿多，神疲，气短，动则汗出，脉弦缓，属于
A. 气虚证
B. 气陷证
C. 气不固证
D. 气脱证
E. 血脱证

正确答案：C。气不固证

解析：气虚不能固摄二便，则小便淋漓不尽，夜尿多；气不摄津，则动则汗出；神疲，气短均为气虚的表现；故辨证为气不固证（C对）。气虚证表现为神疲乏力，少气懒言，气短，头晕目眩，自汗，动则诸症加剧，舌质淡嫩，脉虚（A错）。气陷证表现为头晕眼花，神疲气短，腹部坠胀，或久泄久痢，或见内脏下垂、脱肛、阴挺等，舌质淡嫩，脉虚（B错）。气脱证表现为呼吸微弱而不规则，汗出不止，口开目合，手撒身软，神识朦胧，面色苍白，口唇青紫，二便失禁，舌质淡白，舌苔白润，脉微（D错）。血脱证表现为面色苍白，头晕，眼花，心悸，舌淡或枯白，脉微或芤，且与血虚症状共见（E错）。